肾病综合征不具有下列哪项特点
A. 血尿
B. 蛋白尿
C. 严重水肿
D. 低蛋白血症
E. 高脂血症

正确答案：A。血尿